根据与磷酸羟基相连的取代基团不同可将甘油磷脂分为几类，除外的是
A. 磷脂肪酸
B. 磷脂酰胆碱
C. 磷脂酰乙醇胺
D. 磷脂酰肌醇
E. 肝磷脂

正确答案：E。肝磷脂

解析：甘油磷脂由甘油、脂肪酸、磷酸及含氮化合物等组成，在甘油的第1位和第2位羟基上各结合1分子脂肪酸，通常第2位脂肪酸为花生四烯酸，在第3位羟基再结合1分子磷酸，即为最简单的甘油磷脂——磷脂肪酸。根据与磷酸羟基相连的取代基团不同，可将甘油磷脂分为六类，即磷脂肪酸、磷脂酰胆碱（卵磷脂）、磷脂酰乙醇胺（脑磷脂）、磷脂酰肌醇、二磷脂酰甘油（心磷脂）和磷脂酰丝氨酸等。掌握“甘油磷脂、胆固醇和血脂蛋白代谢”知识点。